女童，7岁，乳牙龋坏较多，六龄牙完全萌出，窝沟较深，无明显龋坏，要求预防，该患者首选的龋病预防措施是六龄牙的窝沟封闭。酸蚀时间应为
A. 10秒
B. 30秒
C. 70秒
D. 50秒
E. 60秒

正确答案：B。30秒

解析：本题考查恒牙酸蚀时间。女童，7岁（进入替牙期），乳牙龋坏较多，六龄牙完全萌出（恒牙萌出），窝沟较深，无明显龋坏，要求预防，该患者首选的龋病预防措施是六龄牙的窝沟封闭，酸蚀时间应为30秒（B对）。由于患者乳牙龋坏较多，而新萌出的六龄齿窝沟较深，应做好预防龋坏的措施。恒牙酸蚀时间一般为20～30秒（ACD错），乳牙酸蚀时间一般为60秒（E错）。